影响胎儿和婴儿软骨发育，孕妇及哺乳妇女不宜用的药物是
A. 四环素类
B. 喹诺酮类
C. 磺胺类
D. 硝基呋喃类
E. 甲氧苄啶

正确答案：B。喹诺酮类